女，30岁，妊娠35周，发现血压升高3周，今晨突然腹痛，呈持续性，阴道有少量流血，查体P112次/分，BP150/98mmHg，子宫张力大，宫底前壁压痛明显，胎心100次/分，尿蛋白（＋＋）。最可能的诊断是
A. 子宫破裂
B. 先兆子宫破裂
C. 前置胎盘
D. 早产临产
E. 胎盘早剥

正确答案：E。胎盘早剥

解析：妊娠中晚期孕妇，发现血压高(收缩压≥140mmHg和（或）舒张压≥90mmHg），蛋白尿(++），诊断为子痫前期（胎盘早剥病因）。患者今晨突发剧烈腹痛，阴道少量流血、伴有子宫张力增高和子宫压痛，据其病史、体征及实验室检查，诊断为1.子痫前期；2.胎盘早剥（E对）。前置胎盘（C错）典型症状为妊娠晚期或临产后发生无诱因、无痛性反复阴道流血，腹部检查：子宫软，无压痛，轮廓清楚（P148）。先兆子宫破裂（B错）常见于产程长、有梗阻性难产因素的产妇，可有病理缩复环（P212）。子宫破裂（A错）多见于子宫下段剖宫产切口瘢痕破裂（P212），临床表现为突感下腹撕裂样剧痛，阴道流血，而后全腹腹膜刺激征阳性，出现失血性休克。早产临产（D错）时产妇子宫规则收缩，宫颈扩张（P96）。